下列哪种营养素是谷胱甘肽过氧化物酶的组成成分
A. 钙
B. 硒
C. 碘
D. 铁
E. 铜

正确答案：B。硒